急性胎儿窘迫的重要临床征象不包括
A. 胎心率异常
B. 胎动减少
C. 羊水胎粪污染
D. 脐带异常
E. 胎儿头皮血pH＜7.20

正确答案：C。羊水胎粪污染

解析：急性胎儿窘迫的重要临床征象包括产时胎心率异常（A对）、胎动异常（B对）、酸中毒，10%~20%的分娩中会出现羊水胎粪污染，羊水中胎粪污染不是胎儿窘迫的征象（C错，为本题正确答案）。采集胎儿头皮血进行血气分析，若pH＜7.20，可诊断为胎儿酸中毒（E对）；胎盘功能减退（D对）会影响胎盘的物质交换能力，直接影响胎儿的氧供给，容易导致胎盘窘迫的发生。